下列给药途径中，一次注射量应在0.2ml以下的是
A. 静脉注射
B. 脊椎腔注射
C. 肌内注射
D. 皮内注射
E. 皮下注射

正确答案：D。皮内注射

解析：本题考查注射给药的给药部位和吸收途径。皮内注射（D对）注射量在0.2ml以内；静脉注射（A错）剂量超过10ml；椎管注射（B错）剂量不得超过10ml；肌内注射（C错）用量为1～5ml；皮下注射（E错）用量为1～2ml。